患者，男，70岁，前列腺癌，多发骨转移，在应用阿片类药物治疗的过程中出现了腰腿疼痛加重，考虑椎体转移相关的神经病理性疼痛。为控制疼痛症状，可选用的药物有
A. 利多卡因
B. 哌替啶
C. 卡马西平
D. 阿米替林
E. 加巴喷丁

正确答案：C、D、E。卡马西平；阿米替林；加巴喷丁

解析：本题考查止痛药。为控制疼痛症状，可选用的药物有卡马西平（C对）、阿米替林（D对）、加巴喷丁（E对）。推荐姑息治疗用于缓解癌症疼痛的基本药品目录如下。轻度、中度疼痛：对乙酰氨基酚，布洛芬，双氯芬酸，曲马多，可待因；中度、重度疼痛：吗啡（即释剂或缓释剂），芬太尼（透皮贴剂），羟考酮，美沙酮（即释剂）；神经病理性疼痛：阿米替林，卡马西平，地塞米松，加巴喷丁；内脏疼痛：丁溴酸东莨菪碱。利多卡因（A错）为局麻药。哌替啶（B错）不用于癌性疼痛。